男性，35岁，因慢性再生障碍性贫血2年，头晕、乏力、心悸2天入院。入院时检查：贫血外貌，Hb50g/L，患者既往有多次输血史，1个月前在输血过程中曾出现发热反应，体温达39.5℃，经对症处理缓解。此次给予输血治疗，首选的血液制品是
A. 全血
B. 洗涤红细胞
C. 浓缩红细胞
D. 红细胞悬液
E. 少白细胞的红细胞

正确答案：E。少白细胞的红细胞

解析：本例患者患有慢性再生障碍性贫血，多次输血，且在输血过程中出现过发热反应，因此其首选的血液制品应为少白细胞的红细胞（E对）。因为发热反应主要由白细胞及血小板引起，而洗涤红细胞中主要为红细胞，仅含少量血浆、无功能白细胞及血小板，因此输注洗涤红细胞能有效预防发热反应。由于全血（A错）中成分多，易引发输血反应及浪费，一般仅用于自体输血或出现大量失血者；浓缩红细胞（红细胞比容高，适用于各种急性失血、慢性贫血及心功能患者而需输血者）（C错）、红细胞悬液（去除了大部分血浆）（D错）、洗涤红细胞（B错）常用于输血过敏的患者。